下列各项中错误的是
A. 人群对HCV普遍易感
B. 人感染HCV后可以产生中和性抗体
C. 丙型肝炎的发病无明显季节性
D. HCV传播途径以医源性传播为主
E. 血液透析患者是HCV感染的高危人群

正确答案：B。人感染HCV后可以产生中和性抗体